下颌牙列的纵（牙合）曲线是一条
A. 凸向上的曲线
B. 凸向下的曲线
C. 凹向上的曲线
D. 凹向下的曲线
E. 与（牙合）平面平行

正确答案：C。凹向上的曲线

解析：下颌牙列的纵（牙合）曲线：又名Spee曲线。它是连接下颌切牙的切嵴、尖牙的牙尖以及前磨牙、磨牙的颊尖所形成的一条凹向上的曲线。掌握“牙列”知识点。